以牛乳为基础的改造奶制品，使宏量营养素成分尽量“接近”于人乳，适合于0～6个月婴儿人工喂养的是
A. 母乳喂养
B. 牛乳喂养
C. 婴儿配方奶粉
D. 羊乳喂养
E. 马乳喂养

正确答案：C。婴儿配方奶粉

解析：婴儿配方奶粉：是以牛乳为基础的改造奶制品，使宏量营养素成分尽量“接近”于人乳，适合于年幼婴儿喂养，为0～6个月婴儿人工喂养的首选。掌握“婴儿喂养方法”知识点。